25岁初产妇，妊娠39周，阵发性腹痛20小时，10～12分钟宫缩一次，持续30秒，宫口开大2cm。若进入第二产程后，胎头+3，胎心90次/分，此时的处理应是
A. 立即行剖宫产术
B. 等待自然分娩
C. 行产钳术助娩
D. 静脉滴注缩宫素
E. 静注地西泮

正确答案：C。行产钳术助娩

解析：青年初产妇，妊娠39周（妊娠28周及以后为妊娠晚期），阵发性腹痛20小时，宫口开大2cm（潜伏期是指从临产出现规律宫缩至宫口扩张3cm，最大时限16小时，提示潜伏期延长），10～12分钟宫缩一次，持续30秒（协调性子宫收缩乏力宫缩持续时间短，间歇期长且不规律，宫缩＜2次/10分钟），故该孕妇可诊断为协调性子宫收缩乏力。进入第二产程后，胎头已降至坐骨棘平面以下3cm（+3），胎头已衔接，是经阴道分娩的良好状态，不需立即行剖宫产（A错）。由于胎心率减慢（正常值110～160次/分），说明胎儿宫内窘迫，应立即行产钳术助产（C对B错）。静脉滴注缩宫素（P189）（D错）适用于协调性宫缩乏力、宫口扩张≥3cm、胎心良好、胎位正常、头盆相称者。静注地西泮（P189）（E错）主要用于宫口扩张缓慢合并宫颈水肿者